慢性闭锁性牙髓炎对温度测验的反应为
A. 立即引起剧烈疼痛
B. 无疼痛
C. 立刻引起轻微的钝痛
D. 出现迟缓性反应或反应迟钝
E. 无反应

正确答案：D。出现迟缓性反应或反应迟钝

解析：本题考查可复性、急慢性牙髓炎。慢性闭锁性牙髓炎对温度测验的反应为出现迟缓性反应或反应迟钝（D对）。